血虚的病变多见于哪两脏
A. 心与肺
B. 心与肾
C. 心与脾
D. 心与肝
E. 脾与肝

正确答案：D。心与肝

解析：血虚是指血液不足或滋润濡养功能减退引起的病理变化。由于肝藏血，心主血，故血虚病变以心肝两脏多见（D对）。